患儿女，1岁。腹泻2天，黄色水样大便，每日7～8次，呕吐每日2～3次，尿量稍减少。查体：口唇黏膜稍干，眼窝稍凹陷，皮肤弹性可，哭有眼泪。化验血钠145mmol/L，正确的诊断是
A. 轻度低渗性脱水
B. 轻度等渗性脱水
C. 中度等渗性脱水
D. 中度高渗性脱水
E. 重度等渗性脱水

正确答案：B。轻度等渗性脱水